与心身疾病的诊断无关的是
A. 有明确的临床症状
B. 有明确的体征
C. 有明确病理学改变
D. 有明确的心理社会因素
E. 无需排除神经症因素

正确答案：E。无需排除神经症因素

解析：心身疾病的诊断标准：①有明确的临床症状、体征和病理学改变。②有明确的心理社会因素，并且与上述改变构成因果关系。③排除神经症、精神病和理化、生物学因素引起的疾病。掌握“心身疾病”知识点。